能开郁散结，清泄润肺的药是
A. 薏苡仁
B. 川贝母
C. 车前子
D. 泽泻
E. 浙贝母

正确答案：B。川贝母

解析：本题考查的是川贝母的性能特点。能开郁散结，清泄润肺的药是川贝母（B对）。川贝母：【性能特点】本品甘润辛散，苦微寒清泄，入肺、心经，为清泄润肺之品。善清肺化痰、润肺止咳，为肺热燥咳及虚劳咳嗽之要药；能开郁散结，治痰热或火郁胸闷、疮肿瘰疬。薏苡仁（A错）：【性能特点】本品甘淡渗利兼补，微寒能清，入脾、胃、肺经，利水而不伤正、健脾而不滋腻。生用甘淡微寒，渗利清补，既能清利湿热、除痹排脓，又略兼健脾，湿热或又兼脾虚者宜用。炒用性平，甘淡渗利而兼补，健脾渗湿止泻，脾虚湿盛无热或热不盛者宜用。生用长于利湿、除痹、清热、排脓；炒用长于健脾止泻。车前子（C错）：【性能特点】本品甘寒质滑清利，入肾经，既利水清热而通淋，又实大便而止泻，治下焦湿热、水肿有热及暑湿水泻；入肝经，清泻肝火而明目，治肝热目赤；入肺经，清肺化痰而止咳，治痰热咳嗽。故凡湿热、肝热、痰热所致病证均可选用。泽泻（D错）：【性能特点】本品甘寒渗利清泄，入肾与膀胱经。既利水渗湿，又清泻肾（相）火与膀胱之热，故下焦湿热、痰饮及相火妄动之证皆可选用。浙贝母（E错）：【性能特点】本品苦寒清泄，入肺、心经，为清热开泄之品。功似川贝母而长于清泄热邪、开郁散结，多用于痰热、风热咳嗽及瘰疬疮肿等。